应用左旋多巴可治疗某些肝性脑病患者，其机制是
A. 降低血氨
B. 入脑后可形成正常神经递质
C. 促进脑氨的清除
D. 促进支链氨基酸进入脑组织
E. 减少芳香氨基酸进入脑内

正确答案：B。入脑后可形成正常神经递质

解析：应用左旋多巴可明显改善肝性脑病患者的状况，其机制是入脑后可形成正常神经递质（B对），使正常神经递质增多，并与假性神经递质竞争，使神经传导功能恢复，有助于维持觉醒。